依照《处方药与非处方药流通管理暂行规定》，不得有奖销售的药品是
A. 乙类非处方药
B. 甲类非处方药
C. 处方药、非处方药
D. 非处方药
E. 处方药

正确答案：C。处方药、非处方药

解析：本题考查药店零售管理。依照《处方药与非处方药流通管理暂行规定》，不得有奖销售的药品是处方药、非处方药（C对）。《处方药与非处方药流通管理暂行规定》第三章药店零售第十四条：处方药（E错）、非处方药（D错）不得采用有奖销售、附赠药品或礼品销售等销售方式，暂不允许采用网上销售方式